男性儿童，左肘摔伤急诊就医。小夹板外固定后，前臂高度肿胀，手部青白发凉，麻木无力，经拍X线片，诊断为左肱骨髁上骨折，若不及时处理，其最可能的后果是
A. 感染
B. 缺血性骨坏死
C. 骨化性肌炎
D. 关节僵硬
E. 缺血性肌挛缩

正确答案：E。缺血性肌挛缩

解析：患儿左肱骨髁上骨折后，前臂高度肿胀，手部青白发凉，麻木无力，应考虑为前臂骨筋膜室综合征。如果不及时处理，很有可能会发生缺血性肌挛缩（E对）。感染（A错）为骨折的晚期并发症，主要见于开放性骨折。缺血性骨坏死（B错）多见于股骨头下骨折和腕舟状骨骨折等。骨化性肌炎（C错）又称损伤性骨化，主要见于关节扭伤、脱位或关节附近骨折。关节僵硬（D错）是由于骨折后长期制动引起的并发症。